单纯饮食控制及体育锻炼无效的2型糖尿病肥胖者首先使用的降糖药是
A. 瑞格列奈
B. 格列美脲
C. 二甲双胍
D. 普萘洛尔
E. 格列喹酮

正确答案：C。二甲双胍

解析：本题考查降糖药的临床作用。二甲双胍（C对）为目前临床上主要使用的双胍类药，首选用于单纯饮食控制及体育锻炼治疗无效的2型糖尿病，特别是肥胖的2型糖尿病，对磺酰脲类疗效差的糖尿病患者与磺酰脲类口服降血糖药合用。瑞格列奈（A错）为非磺酰脲类促胰岛素分泌药，吸收快、起效快，既可降低空腹血糖，又可降低餐后血糖，无需餐前0.5h服用，因而又称为“餐时血糖调节剂”。格列美脲（B错）为磺酰脲类促胰岛素分泌药，用于食物、运动疗法及减轻体重均不能满意控制血糖的非胰岛素依赖型糖尿病。格列喹酮（E错）为磺酰脲类促胰岛素分泌药，适用于伴有肾功能不全的二型糖尿病患者。普萘洛尔（D错）用于高血压、心绞痛、室上性快速心律失常、室性心律失常、心肌梗死，临床上不用做降糖药。